下列不属于养生原则的是
A. 顺应自然
B. 形神兼养
C. 调养脾胃
D. 因人而异
E. 因地制宜

正确答案：E。因地制宜

解析：因地制宜是指根据地理环境特点，制定适宜方药的治疗原则，并不属于养生原则（E错，为本题正确答案）；顺应自然，是中医养生学的重要原则。人以天地之气生，四时之法成。人生干天地之间，依赖于自然而生存，同时也受到自然规律的支配和制约，即人与天地相参，与日月相应（A对）；形神共养，指形体与精神的协调统一，身心和谐的养生原则（B对）；调养脾胃，指利用各种手段和方法来调护保养脾胃，发挥脾升胃降协调、受纳运化相因、水谷精气充足、营养脏腑经络及四肢百骸的功能（C对）；形体锻炼、调摄饮食等养生方法均需要因人而异（D对）。